环境污染健康影响评价
A. 将来健康影响的评价
B. 目前健康影响的评价
C. 过去健康影响的评价
D. 目前和将来健康影响的评价
E. 过去和目前健康影响的评价

正确答案：E。过去和目前健康影响的评价

解析：本题考查环境污染健康影响评价。环境污染健康影响评价是对现有的环境污染包括长时间污染物排放或突发性事故引起的环境污染对健康造成影响的评价（E对ABCD错）。